雷贝拉唑的主要作用是
A. 中和胃酸
B. 促进胃排空
C. 抑制胃酸分泌
D. 粘膜保护作用
E. 阻断胃泌素受体

正确答案：C。抑制胃酸分泌

解析：雷贝拉唑是H⁺-K⁺-ATP酶抑制剂，可抑制胃壁细胞向胃粘膜腔泵出H⁺，降低胃内HCl水平，是最直接有效的抑制胃酸产生的手段（C对）。中和胃酸（A错）即抗酸药，常用的有碳酸钙、氢氧化镁、三硅酸镁、氢氧化铝、碳酸氢钠等。促进胃排空（B错）即增强胃肠动力药主要是西沙比利等。黏膜保护作用（D错）（P306）即黏膜保护剂，增强胃粘膜屏障功能的药物，常用的有米索前列醇、恩前列素、硫糖铝等。阻断胃泌素受体（E错）（P306）的药物主要是丙谷胺，与胃泌素竞争胃泌素受体，有抑制胃酸分泌的作用。